有关气雾剂的叙述中，错误的为
A. 拋射剂在耐压的容器中产生压力
B. 抛射剂是气雾剂中药物的溶剂
C. 拋射剂是气雾剂中药物的稀释剂
D. 拋射剂是一类高沸点物质
E. 拋射剂在常温下蒸气压大于大气压

正确答案：D。拋射剂是一类高沸点物质

解析：本题考查的是气雾剂中抛射剂的特点。气雾剂的抛射剂为低沸点液化气体（D错，为本题正确答案）。气雾剂的抛射剂：为适宜的低沸点液化气体，常温下蒸气压大于1个大气压（E对），当阀门打开时，抛射剂急剧气化产生压力（A对），克服了液体分子间的引力，将药物分散成雾状微粒或泡沫状、干粉状喷出。因此，抛射剂是喷射药物的动力，有时兼作药物的溶剂（B对）和稀释剂（C对）。根据气雾剂所需压力，可将两种成几种抛射剂以适宜比例混合使用